下列不属于地高辛药理作用的是
A. 有正性肌力作用
B. 对传导组织和心肌电生理特性的影响
C. 加快心率作用
D. 利尿作用
E. 对神经和内分泌系统的作用

正确答案：C。加快心率作用

解析：地高辛药理作用：①正性肌力作用②减慢心率作用③对传导组织和心肌电生理特性的影响④对神经和内分泌系统的作用⑤利尿作用⑥对血管的作用掌握“强心苷、ACE抑制剂”知识点。